复方丹参片的使用注意事项
A. 孕妇慎用
B. 年老者慎用
C. 脾胃虚寒者慎用
D. 肝肾功能异常者慎用

正确答案：A、C、D。孕妇慎用；脾胃虚寒者慎用；肝肾功能异常者慎用

解析：本题考查复方丹参片的注意事项。复方丹参片的使用注意事项孕妇慎用（A对）、脾胃虚寒者慎用（C对）、肝肾功能异常者慎用（D对）。复方丹参片（丸、胶囊、滴丸）【注意事项】对本品及所含成分过敏者禁用。过敏体质者慎用。孕妇慎用。寒凝血瘀胸痹心痛者不宜使用，脾胃虚寒者慎用。服药期间，忌食生冷、辛辣、油腻食物，忌烟、酒、浓茶。治疗期间，如心绞痛持续发作，宜加用硝酸酯类药。如果出现剧烈心绞痛、心肌梗死等，应及时送医院救治。个别人服药后胃脘不适，宜饭后服用。肝肾功能异常者慎用。